婴幼儿下颌下间隙感染来源多为
A. 牙源性
B. 腺源性
C. 损伤性
D. 血源性
E. 医源性

正确答案：B。腺源性

解析：成人感染常来自下颌磨牙根尖感染和第三磨牙冠周炎，婴幼儿常继发于化脓性下颌下淋巴结炎，所以多来源于腺源性。掌握“口腔颌面部感染概论”知识点。